以下哪一项属于梅－罗氏综合征的临床表现
A. 沟纹舌、肉芽肿性唇炎、面神经麻痹
B. 沟纹舌、巨舌、面肌抽搐
C. 面瘫、巨舌、口角炎
D. 肉芽肿性唇炎、巨舌、面肌抽搐
E. 地图舌、肉芽肿性唇炎、面肌抽搐

正确答案：A。沟纹舌、肉芽肿性唇炎、面神经麻痹

解析：沟纹舌，同时出现肉芽肿性唇炎，面神经麻痹或有面神经麻痹史，则诊断为梅-罗综合征。掌握“地图舌、沟纹舌及舌乳头炎”知识点。